女婴，9个月，腹泻3～4天，大便每日10余次，呈稀水样，伴呕吐，每天2～3次，查体：皮肤稍干，弹性差，心音低钝，入院时最重要的处理是
A. 控制感染
B. 纠正水、电解质紊乱
C. 给肠道微生态制剂
D. 给止吐药
E. 给肠道黏膜保护剂

正确答案：B。纠正水、电解质紊乱

解析：患儿腹泻、呕吐3～4天，呈稀水样（急性腹泻表现），查体：皮肤稍干，弹性差，心音低钝（提示患儿脱水），据患者临床表现，体征，诊断为急重型腹泻，入院时最重要的处理是纠正水、电解质紊乱（B对）。控制感染（A错）、给肠道微生态制剂（C错）、给止吐药（D错）及给肠道黏膜保护剂（E错）均可作为急性腹泻的后续治疗措施，且需要注意的是，对水样便患者，多数为病毒及非侵袭性细菌所致，一般不用抗生素（P232-233）。